治疗血虚不孕症，应首选
A. 当归补血汤
B. 当归芍药散
C. 桃红四物汤合归脾汤
D. 开郁种玉汤
E. 温土毓麟汤合归脾汤

正确答案：E。温土毓麟汤合归脾汤

解析：温土毓麟汤合归脾汤功在温脾暖肾，益气补血，适用于血虚不孕症（E对）。当归补血汤（A错）具有益气生血的功效，多用于治劳倦内伤，气血虚，阳浮于外之虚热证。当归芍药散（B错）具有养血调肝，健脾利湿，养血益脾功效，主治妇人妊娠肝郁气滞证。桃红四物汤合归脾汤（C错）具有活血祛瘀，补气养血的功效，用于血瘀血虚证。开郁种玉汤（D错）具有疏肝解郁、养血理脾的功效，适用于肝郁型不孕症。